下列哪项不是心室重塑的表现
A. 心肌肥大
B. 心肌细胞表型改变
C. 细胞外基质改建
D. 非心肌细胞增生
E. 心肌细胞凋亡

正确答案：E。心肌细胞凋亡

解析：慢性心衰时，机体通过心室重塑进行代偿。心室重塑包括心肌细胞重塑和心肌间质重塑。心肌细胞重塑表现为量的改变即心肌肥大（A错）和质的改变即细胞表型改变（B错），心肌间质重塑表现为细胞外基质改建（C错）和非心肌细胞增生（D错）。心肌细胞凋亡（E对）是心衰发生的原因之一，而心室重塑是发生心衰后心脏代偿的表现。